脾肾两亏的目态是
A. 戴眼反折
B. 目睛微定
C. 昏睡露睛
D. 双睑下垂
E. 横目斜视

正确答案：D。双睑下垂

解析：双睑下垂，多为先天不足，脾肾亏虚（D对）。目睛凝视：又称目睛微定。指病人两眼固定，不能转动。固定上视者，称戴眼反折；固定侧视者，称横目斜视。多属肝风内动之征；或见于脏腑精气耗竭，或痰热内闭证（ABE错）。昏睡露睛指病人昏昏欲睡，睡后胞睑未闭而睛珠外露。多属脾胃虚衰，或吐泻伤津（C错）。